某男性患者，29岁，体健。诉牙龈自发出血1月，熬夜3天后出血严重并伴有牙龈疼痛和口臭，伴有低热和全身乏力。最可能的诊断是急性坏死性溃疡性龈炎。若诊断为急性坏死性溃疡性龈炎，最有价值的辅助检查是菌斑涂片。若诊断为急性坏死性溃疡性龈炎，它的致病菌主要是
A. 放线菌和螺旋体
B. 放线菌和梭性杆菌
C. 梭形杆菌和链球菌
D. 梭形杆菌和螺旋体
E. 螺旋体和链球菌

正确答案：D。梭形杆菌和螺旋体

解析：本题考查急性坏死性溃疡性龈炎的致病菌。急性坏死性溃疡性龈炎的细菌学涂片检查可见大量梭形杆菌和螺旋体（D对），这是它的主要致病菌。放线菌（AB错）与牙龈炎关系密切。链球菌（CE错）与球菌性口炎密切相关。